输尿管是将肾产生的尿液输送至膀胱的肌性管道，行程较长约20~30cm，在腹膜后下行，入盆腔注入膀胱。在女性与子宫动脉相交叉。输尿管的第2狭窄位于
A. 起始处
B. 小骨盆入口处
C. 穿膀胱壁处
D. 接尿道处
E. 以上均不是

正确答案：B。小骨盆入口处

解析：输尿管的第2狭窄位于小骨盆上口（B对），输尿管跨过髂血管处。